关于复合固定桥的叙述中，错误的是
A. 含有四个或四个以上的牙单位
B. 含有两个以上基牙
C. 由两种或三种基本类型的固定桥组合而成
D. 基牙数目多且分散，不易获得共同就位道
E. 以上都不是复合固定桥

正确答案：E。以上都不是复合固定桥

解析：本题考查复合固定桥。双端固定桥、半固定桥、单端固定桥和复合固定桥都属于固定桥的类型。复合固定桥是包含上述三种基本类型中的两种，或者同时具备三种的复合组成形式（C对）。比较常见的设计是1个双端固定桥连接1个单端固定桥，或者是连接1个半固定桥，故复合固定桥一般包含至少2个或3个至多个的间隔基牙（B对），包含4个或4个以上的牙单位（A对）。复合固定桥的基牙可能包含前牙、后牙或者同时包含前后牙，形成一个沿牙弓呈弧形的长桥。在咀嚼运动中，各基牙的受牙合力反应多数时候不一致，有时相互支持有利于固定桥的固位和支持，有时相互影响不利于固定桥的固位和支持；当复合固定桥的基牙数多，基牙离散，桥体跨度较长时，获得共同就位道是比较困难的（D对），其中一部分可设计为半固定桥。故以上都不是复合固定桥（E错，为本题的正确答案）的说法是错误的。